哮喘长期治疗的首选药物是
A. 磷酸二酯酶抑制剂
B. 白三烯受体阻断剂
C. 长效β₂受体激动剂
D. M胆碱受体阻断剂
E. 吸入性糖皮质激素

正确答案：E。吸入性糖皮质激素

解析：本题考查吸入性糖皮质激素。哮喘长期治疗的首选药物是吸入性糖皮质激素（E对）。吸入性糖皮质激素有丙酸倍氯米松、丙酸氟替卡松和布地奈德，糖皮质激素具有强大的抗炎功能，抑制炎症细胞的迁移和活化，抑制炎症介质的释放，抑制细胞因子的生成，增强平滑肌细胞β₂受体的反应性可以减轻气道水肿和黏液的分泌，减轻气道炎症反应，是当前控制气道炎症、控制哮喘症状、预防哮喘发作的最有效药物，是哮喘长期治疗的首选药物。磷酸二酯酶抑制剂(A错）是一种抑制磷酸二酯酶活性的药物，选择性的磷酸二酯酶3，4，5抑制剂在心衰、哮喘、阳痿等疾病中，具有广泛的应用前景。白三烯受体阻断剂（B错）对人体支气管平滑肌的收缩作用较组胺、血小板活化因子（PAF）强约1000倍，它尚可刺激黏液分泌，增加血管通透性，促进黏膜水肿形成。长效β₂受体激动剂（C错）推荐与吸入性糖皮质激素联合使用，尤其适合于中、重度持续哮喘患者长期治疗。伴有前列腺增生的哮喘患者不宜选用M胆碱受体阻断剂（D错）。